某药稳态分布容积（Vss）为198L，提示该药
A. 与血浆蛋白结合率较高
B. 主要分布在血浆中
C. 广泛分布于器官组织中
D. 主要分布在红细胞中
E. 主要分布在血浆和红细胞中

正确答案：C。广泛分布于器官组织中

解析：本题考查稳态分布容积（Vss）。某药稳态分布容积(Vss）为198L，提示该药广泛分布于器官组织中（C对）；分布容积（V）是药物的特征参数，对于具体药物来说，V是个确定的值，其值的大小能够表示出该药物的分布特性。药物的V远大于体液总体积时，表示其血中药物浓度很小，说明组织中的药物多，提示药物在某些组织或器官可能存在蓄积。